要观察儿童第三磨牙牙胚情况时最好采用
A. 下颌横断（牙合）片
B. 口内根尖片
C. 上下颌第三磨牙口外投照片
D. （牙合）翼片
E. 下颌前部（牙合）片

正确答案：C。上下颌第三磨牙口外投照片

解析：本题考查上下颌第三磨牙口外投照片。要观察儿童第三磨牙牙胚情况时最好采用上下颌第三磨牙口外投照片（C对）。上下颌第三磨牙口外投照片可用于观察的项目包括：第三磨牙的形态、第三磨牙萌出情况、第三磨牙阻生方向、儿童第三磨牙牙胚发育情况。